下列哪一项属于医学科研伦理的要求
A. 动机纯正
B. 敢于怀疑
C. 知识公开
D. 诚实严谨
E. 以上都是

正确答案：E。以上都是

解析：医学科研伦理的要求包括：动机纯正、诚实严谨、敢于怀疑、公正无私、团结协作、知识公开。掌握“医学科研伦理的含义和要求”知识点。